女，65岁，2型糖尿病病史20年，查体：BP160/95mmHg，心率65次/分，实验室检查：血Scr160μmol/L，血K⁺4.2mmol/L.尿蛋白（+），该患者降压药首选
A. 利尿剂
B. α受体拮抗剂
C. 血管紧张素Ⅱ受体拮抗剂
D. 钙通道阻滞剂
E. β受体拮抗剂

正确答案：C。血管紧张素Ⅱ受体拮抗剂

解析：女，65岁，2型糖尿病病史20年，查体：BP160/95mmHg（高血压2级），心率65次/分，实验室检查：血Scr160μmol/L（女性正常值44-97μmol/L），血K⁺4.2mmol/L.尿蛋白（+），该患者降压药首选血管紧张素Ⅱ受体拮抗剂（C对）。该患者患有糖尿病且尿蛋白（+），选用ARB能改善胰岛素抵抗和减少尿蛋白。患者血Scr160μmol/L，未超过3mg/dl，所以首选血管紧张素Ⅱ受体拮抗剂。该患者降压药可加用利尿剂，但不为首选（A错）。钙通道阻滞剂（D错）可用于合并糖尿病的高血压患者，且对老年人降压疗效好，但不作为首选。患者心率不快且β受体拮抗剂（E错）增加胰岛素抵抗，可能掩盖和延长低血糖反应，因此不考虑该药。α受体拮抗剂（B错）副作用较多不作为首选。